下列哪项不属于五软的范畴
A. 头项软
B. 口软
C. 发软
D. 肌肉软
E. 足软

正确答案：C。发软

解析：该题考查五软的内容，理解记忆即可。五软指头项软（A对）、口软（B对）、手软（C错，为本题正确答案）、足软（E对）、肌肉软（D对）。